原研药物为缓释片，参比制剂为非静脉给药，相同剂量AUC的比值是
A. Tmax
B. 波动度
C. 绝对生物利用度
D. Css
E. 相对生物利用度

正确答案：E。相对生物利用度

解析：本题考查相对生物利用度。生物利用度可分为绝对生物利用度与相对生物利用度，相对生物利用度（E对）是以其他非静脉途径给药的制剂为参比制剂获得的药物活性成分吸收进入血液循环的相对量，用于剂型之间或同种剂型不同制剂之间的比较。